男性，65岁，慢性咳嗽、咳痰20年。4天前受凉后咳嗽加重，痰量增多，咳黏脓痰。诊断慢支急性发作期的依据是
A. 年龄大于60岁
B. 咳嗽、咳痰
C. 痰呈黏脓性
D. 咳加重，痰量增多4天
E. 肺部有啰音

正确答案：D。咳加重，痰量增多4天